关于真核生物mRNA结构的描述，错误的是
A. 5'-端留有特殊的内含子
B. 3'-端有特殊的“尾”结构
C. 3'-端存在非翻译序列
D. 5'-端有特殊“帽子”结构
E. 含有开放阅读框架区

正确答案：A。5'-端留有特殊的内含子

解析：内含子是位于外显子（P272）之间、与mRNA剪接过程中被删除部分相对应的间隔序列，不会出现在真核生物mRNA的结构中（A错，为本题正确答案）。真核生物mRNA的结构特点有：①真核生物mRNA的5’-端有特殊帽结构（甲基鸟嘌呤-三磷酸核苷）（D对），与之相连的是5’非翻译区；②真核生物mRNA的3’-端有特殊的“尾”结构（多聚腺苷酸尾）（B对），与之相连的是3’非翻译区（C对）；③含有开放读框（0RF）（E对），即从成熟mRNA的5’-端起的第一个起始密码子至终止密码子之间的核苷酸序列，其决定多肽链的氨基酸序列。